21三体综合征嵌合型
A. 46，XY（或XX），-14，+t（14q21q）
B. 47，XY（或XX），+21
C. 46，XY（或XX）/47，XY（或XX）+21
D. 46，XY（或XX），-21，+t（21q21q）
E. 46，XY（或XX），-21，+t（21q22q）

正确答案：C。46，XY（或XX）/47，XY（或XX）+21

解析：本题为记忆题。21三体综合征嵌合型的核型为46，XY（或XX）/47，XY（或XX）+21（C对）。46，XY（或XX），-14，+t（14q21q）是21三体综合征易位型（A错）。47，XY（或XX），+21是21三体综合征标准型（B错）。